下列哪一条是队列研究的缺点
A. 不适用于少见病的病因研究
B. 样本代表性差，易产生选择性偏倚
C. 不能计算发病率
D. 省人力、物力、财力
E. 暴露测量不可靠，易产生信息偏倚

正确答案：A。不适用于少见病的病因研究

解析：本题考查队列研究的缺点。队列研究的缺点包括：①不适于发病率很低的疾病的病因研究（A对BCE错）；②由于随访时间较长，对象不易保持依从性，容易产生失访；③在随访过程中，未知变量引入人群，或人群中已知变量的变化等，都可使结局受到影响，使分析复杂化；④研究耗费的人力、物力、财力（D错）和时间较多。